加味左金丸的功能是
A. 疏肝和胃
B. 温胃理气
C. 清热止痢
D. 解表，祛湿，和中
E. 养阴益胃，行气止痛

正确答案：A。疏肝和胃

解析：本题考查的是加味左金丸的功能。加味左金丸的功能是疏肝和胃（A对）。加味左金丸：【功能】疏肝和胃。良附丸：【功能】温胃理气（B错）。白头翁：【功效】清热解毒，凉血止痢（C错）。保济丸：【功能】解表，祛湿，和中（D错）。功能为养阴益胃，行气止痛（E错）的中成药，2022年考试指南未明确说明。